在我国生活饮用水水质标准制定依据中，有一组毒理学指标，其意义为
A. 保证流行病学安全
B. 保证饮用水感官性状良好
C. 保证不产生毒性和潜在性危害
D. 保证不引起介水传染病
E. 以上都不是

正确答案：C。保证不产生毒性和潜在性危害

解析：本题考查我国生活饮用水水质标准制定依据。我国生活饮用水水质标准制定依据中，微生物和消毒剂指标旨在保证饮用水在流行病学上的安全性（A错）；感官性状和一般化学指标旨在保证饮用水感官性状良好（B错）；毒理学指标和放射性指标旨在保证饮用水对人体健康不产生毒性和潜在危害（C对DE错）。